有的（牙合）面（窝沟）龋呈锥形，底部朝牙本质，尖向牙釉质表面，具有这类临床特征的龋病又称
A. 湿性龋
B. 猛性龋
C. 潜行性龋
D. 静止龋
E. 线性牙釉质龋

正确答案：C。潜行性龋

解析：本题考查龋病的分类。有的（牙合）面（窝沟）龋呈锥形，底部朝牙本质，尖向牙釉质表面，狭而深的窝沟处损害更为严重，龋病早期，釉质表面无明显破坏。具有这类临床特征的龋损又称潜行性龋（C对）。湿性龋（A错）又称急性龋，病变进展较快，病变组织颜色较浅，呈浅棕色，质地较软而且湿润，很容易用挖器剔除。猛性龋（B错）指急性龋的一种类型，病程进展很快，多数牙在短时间内同时患龋，常见于颌面及颈部接受放射治疗的患者。静止龋（D错）指龋病发展到某一阶段时，由于病变环境发生变化，隐蔽部位变得开放，原有致病条件发生了改变，龋病不再继续进行，损害仍保持原状。线性牙釉质龋（E错）指主要发生于上颌前牙唇侧的新生线处，龋损呈新月形。